蜂窝织炎是指
A. 发生于皮下组织及阑尾的炎症
B. 一种弥漫性化脓性炎症
C. 以淋巴细胞渗出为主的炎症
D. 由链球菌感染引起的局限性化脓性炎症
E. 没有明显坏死的渗出性炎症

正确答案：B。一种弥漫性化脓性炎症

解析：蜂窝织炎是指由链球菌感染引起的，以中性粒细胞渗出为主（C错）的弥漫性化脓性炎症（B对D错），又因单纯蜂窝织炎一般没有明显的组织坏死，故也是没有明显坏死的渗出性炎症，因此选项E也对，本题不严谨。蜂窝织炎主要发生于皮肤、肌肉和阑尾（A错）。